肾病综合征患者发生血栓并发症，最常见于
A. 肾静脉
B. 冠状血管
C. 下肢静脉
D. 下腔静脉
E. 肺静脉

正确答案：A。肾静脉

解析：肾病综合征患者发生血栓并发症，最常见于肾静脉（A对）。肺血管（E错）、下肢静脉（C错）、下腔静脉（D错）及冠状血管（B错）血栓也可见于肾病综合征患者，但不如肾静脉血栓常见。冠状血管（B错）血栓常见于有高血压、糖尿病、高脂血症的老年患者。下肢静脉（C错）血栓常见于长期卧床的病人。下腔静脉（D错）血栓不常见。肺静脉血栓（E错）常见于瓣膜病患者。